皮质核束经过
A. 内囊前肢
B. 内囊膝
C. 内囊后肢
D. 锥体交叉
E. 都不是

正确答案：B。内囊膝

解析：皮质核束经过内囊膝（B对）；内囊前肢（A错）的投射纤维：主要包括额桥束和由丘脑背内侧核投射到前额叶的丘脑前辐；内囊后肢的投射纤维：经豆丘部的下行纤维束为皮质脊髓束、皮质红核束和顶桥束等；皮质脊髓束经过锥体交叉（D错）。